关于牙周病牙槽骨破坏的形式包括
A. 水平型吸收
B. 反波浪形骨吸收
C. 垂直型吸收
D. 凹坑状吸收
E. 以上均包括

正确答案：E。以上均包括

解析：牙槽骨吸收的方式：①水平型吸收：是较常见的吸收方式。牙槽间隔、唇颊侧或舌侧的牙槽嵴顶呈水平吸收，而使牙槽嵴顶的高度降低，通常形成骨上袋，即牙周袋底在牙槽嵴顶的冠方。②垂直型吸收：也称角形吸收，指牙槽骨发生垂直方向或斜行的吸收，与牙根面之间形成一定角度的骨缺损，牙槽嵴顶的高度降低不多，而靠近牙根侧的骨吸收较多。③凹坑状吸收：指牙槽间隔的骨嵴顶吸收，其中央部分破坏迅速，而颊舌侧骨质仍保留，形成弹坑状或火山口状缺损。它的形成可能因邻面的龈谷区是菌斑易堆积、组织防御力薄弱的部位，该处的牙槽骨易发生吸收。此外，相邻两牙间的食物嵌塞或不良修复体等也是凹坑状吸收的常见原因。④其他形式的骨变化：由于各部位牙槽骨吸收不均匀，使原来整齐而呈薄刃状的骨缘成为参差不齐。正常情况下牙间的骨隔较高，而颊舌侧的骨嵴较低，呈波浪形。当牙间骨隔破坏而下凹，而颊舌面骨嵴未吸收时，使骨嵴呈现反波浪形的缺损。此外，由于外生骨疣或扶壁骨形成、适应性修复等而使唇、颊面的骨增生，使牙槽嵴呈“唇”形或骨架状增厚。这些虽是骨组织对破坏的代偿性修复的表现，但常造成不利于菌斑控制的形态改变。掌握“慢性牙周炎的病因，表现诊断及预后”知识点。